细辛具有的功效是
A. 疏肝下气
B. 回阳救逆
C. 两者均是
D. 两者均不是

正确答案：D。两者均不是

解析：本题考查的是细辛的功效。细辛具有的功效是祛风散寒，通窍，止痛，温肺化饮（D对）。细辛：【功效】祛风散寒，通窍，止痛，温肺化饮。吴茱萸：【功效】散寒止痛，疏肝下气（A错），燥湿止泻。附子：【功效】回阳救逆（B错），补火助阳，散寒止痛。